为了由样本推断总体，样本应该是总体中
A. 任意的一部分
B. 典型部分
C. 有意义的一部分
D. 有价值的一部分
E. 有代表性的一部分

正确答案：E。有代表性的一部分

解析：本题考查样本的定义。样本是为了解总体而观测的总体的一部分，我们常常从一个总体中抽取具有代表性的样本进行调查（E对ABCD错）。